提倡妇女用自检乳房来发现乳腺癌属于
A. 一级预防
B. 二级预防
C. 三级预防
D. 传染病的预防措施
E. 传染病的防疫性措施

正确答案：B。二级预防

解析：本题考查二级预防。第二级预防又称“三早”预防，即早发现、早诊断、早治疗。第二级预防是在疾病早期，症状体征尚未表现出来或难以觉察，通过及早发现并诊断疾病，及时给予适当的治疗，有更大的机会实现治愈。疾病的早发现可通过筛检、病例发现、定期体检等实现。提倡妇女用自检乳房来发现乳腺癌属于二级预防（B对ACDE错）。